豨莶草除祛风湿、通经络外，又能
A. 止血
B. 活血
C. 降血压
D. 消痰水
E. 利小便

正确答案：C。降血压

解析：本题考查的是豨莶草的功效。豨莶草除祛风湿、通经络外，又能降血压（C对）。豨莶草：【功效】祛风湿，通经络，清热解毒，降血压。鹿衔草：【功效】祛风湿，强筋骨，调经止血（A错），补肺止咳。伸筋草：【功效】祛风除湿，舒筋通络，活血（B错）消肿。威灵仙：【功效】祛风湿，通经络，消痰水（D错），治骨鲠。青风藤：【功效】祛风湿，通经络，利小便（E错）。